依据2002年9月11实施的《医疗事故处理条例》，不属于医疗事故的是
A. 医疗机构违反规章造成患者重度残废
B. 在医疗活动中，由于患者病情异常而发生医疗意外
C. 医务人员违反诊疗常规，造成患者一般功能性障碍
D. 医务人员违反护理常规，造成患者轻度残废
E. 药房等非临床科室因过失导致患者人身损害

正确答案：B。在医疗活动中，由于患者病情异常而发生医疗意外

解析：依据2002年9月11实施的《医疗事故处理条例》，不属于医疗事故的是①在紧急情况下为抢救垂危患者生命而采取紧急医学措施造成不良后果的；②在医疗活动中由于患者病情异常或者患者体质特殊而发生医疗意外的（B对）；③在现有医学科学技术条件下，发生无法预料或者不能防范的不良后果的；④无过错输血感染造成不良后果的；⑤因患方原因延误诊疗导致不良后果的；⑥因不可抗力导致不良后果的。医疗机构违反规章造成患者重度残废（A错）、医务人员违反诊疗常规，造成患者一般功能性障碍（C错）、医务人员违反护理常规，造成患者轻度残废（D错）、药房等非临床科室因过失导致患者人身损害（E错）均属于医疗事故。